牙中牙是
A. 融合牙
B. 双生牙
C. 牙内陷
D. 额外牙
E. 畸形中央尖

正确答案：C。牙内陷

解析：牙中牙：是牙内陷最严重的一种。牙齿呈圆锥状，且较其固有形态稍大；X线片示一个牙包于牙中，其实陷入部分的中央不是牙髓，而是含有残余成釉器的空腔。掌握“牙内陷”知识点。